昂丹司琼具有的特点为
A. 有二个手性碳原子，R，S体的活性较大
B. 有二个手性碳原子，R，R体的活性较大
C. 有一个手性碳原子，两个对映体的活性一样大
D. 有一个手性碳原子，S体的活性较大
E. 有一个手性碳原子，R体的活性较大

正确答案：E。有一个手性碳原子，R体的活性较大

解析：本题考查昂丹司琼。昂丹司琼的咔唑环上3位碳具有手性，只有一个手性碳（AB错），其R型体的活性较大（E对CD错），临床上使用外消旋体。